因内含有毒的朱砂而不能过量或长期服用的成药是
A. 七厘散
B. 跌打丸
C. 接骨丸
D. 活血止痛散
E. 接骨七厘片

正确答案：A。七厘散

解析：本题考查的是七厘散的注意事项。因内含有毒的朱砂而不能过量或长期服用的成药是七厘散（A对）。七厘散：【药物组成】血竭、乳香（制）、没药（制）、红花、儿茶、冰片、人工麝香、朱砂。【注意事项】本品应在医生指导下使用。孕妇禁用。骨折、脱臼者宜手法先复位后，再用本品治疗。不宜过量或长期服用。饭后服用可减轻肠胃反应。皮肤过敏者不宜使用。跌打丸（B错）：【注意事项】孕妇禁用。骨折、脱臼者宜手法先复位后再用本品治疗。饭后服用可减轻肠胃反应，脾胃虚弱者慎用。接骨丸（C错）：【注意事项】本品所含马钱子粉有大毒，故应在医生指导下使用。孕妇禁用。骨折、脱臼者应先复位后再用本品治疗。切勿过量服用或持久服用。活血止痛散（D错）：【注意事项】孕妇禁用。宜在饭后半小时服用。脾胃虚弱者慎用。不宜大剂量使用。妇女月经期及哺乳期慎用。服药期间忌生冷、油腻食物。接骨七厘片（E错）：【注意事项】孕妇禁用。骨折、脱臼者应先复位后再用本品治疗。脾胃虚弱者慎用。